蛋白质变性时，不受影响的结构是
A. 蛋白质一级结构
B. 蛋白质二级结构
C. 蛋白质三级结构
D. 蛋白质四级结构
E. 单个亚基结构

正确答案：A。蛋白质一级结构